当血液流经肾一次后，血浆中该物质几乎完全被肾清除的是
A. Na⁺
B. 葡萄糖
C. 菊粉
D. 肌酐
E. 对氨基马尿酸

正确答案：E。对氨基马尿酸

解析：对氨马尿酸（E对）除肾小球滤过外，大部分通过肾小管周围毛细血管向肾小管分泌后排出，当血液流经肾一次后，血浆中该物质几乎完全被肾清除，可作为肾血流量测定试剂。菊粉（C错）全部由肾小球滤过，肾小管既不吸收也不分泌，可作为GFR测定的理想试剂。Na⁺（A错）能被肾小管大部分重吸收。葡萄糖（B错）被肾小管全部重吸收。肌酐（D错）全部由肾小球滤过，不被肾小管重吸收，很少被肾小管排泌。